眼视近物时不会发生
A. 睫状突外伸
B. 睫状肌收缩
C. 睫状小带松弛
D. 晶状体凸度增加

正确答案：A。睫状突外伸

解析：眼视近物时，睫状突内伸（A错，为本题正确答案）；睫状肌收缩（B对），睫状小带松弛（C对），晶状体凸度增加（D对）。